脾属于
A. 呼吸系器官
B. 消化器官
C. 内分泌器官
D. 外分泌器官
E. 淋巴器官

正确答案：E。淋巴器官

解析：脾是人体最大的淋巴器官（E对），淋巴器官包括淋巴结、胸腺、脾和扁桃体。